下列关于慢性病的特性，叙述错误的是
A. 病因复杂
B. 起病隐匿
C. 病程长
D. 病情迁延不愈
E. 人与人之间的传播方式为接触性传播

正确答案：E。人与人之间的传播方式为接触性传播